男，10岁，发热10天，体温38～39℃，刺激性咳嗽明显，胸痛。查体：双肺散在干啰音，胸片：左肺下野淡薄片状阴影。首选的药物治疗为
A. 青霉素
B. 头孢菌素
C. 链霉素
D. 红霉素
E. 无环鸟苷

正确答案：D。红霉素

解析：患者为男性儿童（支原体肺炎的好发年龄），发热，刺激性咳嗽明显（支原体肺炎的典型症状），胸痛，双肺散在干啰音，胸片：左肺下野淡薄片状阴影，根据其临床表现和辅助检查，考虑诊断为支原体肺炎。支原体肺炎早期使用抗生素可减轻症状及缩短病程，大环内酯类抗生素为首选，如红霉素（D对）、罗红霉素。肺炎链球菌肺炎治疗的首选青霉素G（苄星青霉素）（A错）。头孢菌素主要用于G⁺菌、G⁻菌的治疗（药理学P376）（B错）。链霉素对土拉菌病和鼠疫有特效，常为首选（药理学P390）（C错）。环鸟苷（阿昔洛韦）为HSV（单纯疱疹病毒）感染的首选药（药理学P414）（E错）。